根据行为人违反药品法律法规的性质和社会危害程度的不同，可将药品安全法律责任分为
A. 社会责任
B. 民事责任
C. 刑事责任
D. 行政责任

正确答案：B、C、D。民事责任；刑事责任；行政责任

解析：本题考查药品安全法律责任的类型和内容。应当承担的药品安全法律责任包括民事责任（B对）、刑事责任（C对）、行政责任（D对）。药品安全法律责任的类型和内容：根据行为人违反药品法律法规的性质和社会危害程度的不同，可将药品安全法律责任分为刑事责任、民事责任和行政责任。药品生产、流通企业要履行社会责任（A错），保证药品及时生产、配送，医疗机构等采购方要及时结算货款。